意识大部分丧失、强刺激下吞咽反射、角膜反射存在的是
A. 谵妄
B. 嗜睡
C. 昏睡
D. 浅昏迷
E. 深昏迷

正确答案：D。浅昏迷

解析：意识大部分丧失，无自主运动，对声、光刺激无反应，对疼痛刺激尚可出现痛苦的表情或肢体退缩等防御反应。角膜反射、瞳孔对光反射、眼球运动、吞咽反射等可存在是浅昏迷（D对）临床表现。谵妄（A错）是一种以兴奋性增高为主的高级神经中枢急性活动失调状态，临床上表现为意识模糊、定向力丧失、感觉错乱（幻觉、错觉）、躁动不安、言语杂乱。嗜睡（B错）是最轻的意识障碍，是一种病理性倦睡，患者陷入持续的睡眠状态，可被唤醒，并能正确回答和作出各种反应，但当刺激去除后很快又再入睡。昏睡（C错）是近似于人事不醒的意识状态。患者处于熟睡状态，不易唤醒。在强烈刺激下（如压迫眶上神经，摇晃患者身体等）可被唤醒，但很快又再入睡。醒时答话含糊或答非所问。深昏迷（E错）全身肌肉松弛，对各种刺激全无反应，深、浅反射均消失。